男，72岁。排便时突然跌倒，意识丧失，呼吸断续有陈旧心肌梗死和糖尿病病史，无高血压病史，诊断为心脏骤停。最佳的给药途径是
A. 静脉注射
B. 心内注射
C. 肌肉注射
D. 气管内给药
E. 皮下注射

正确答案：A。静脉注射

解析：目前心肺复苏的主要给药方法有静脉注射、气管内给药和心内注射。其中静脉注射是心肺复苏的主要途径，心脏骤停患者在进行心肺复苏时应尽早开通静脉通道，因静脉注射可使药物直接进入血液循环，产生药效快。故心脏骤停时最佳给药途径是静脉注射（A对）。心内注射（B错）是临床抢救的常用技术，主要用于：1．任何原因所致心脏骤停，进行心脏按压，同时需要向心内注射一定药物促进心脏复跳患者；2．胸外及胸内电击除颤，应同时心内注射药物；3．没有除颤设备时，可用药物心内注射除颤。目前国际指南已经不推荐心内注射，原因是严重并发症，如气胸、心脏破裂，且实践证明心内注射抢救成功率不一定高。气管内给药（D错）常在静脉穿刺无法进行时使用。肌肉注射（C错）主要用于不宜或不能做静脉注射，要求比皮下注射更迅速发生疗效时，以及注射刺激性较强或药量较大的药物时。皮下注射（E错）主要在需迅速达到药效、不能或不宜经口服给药时采用，如胰岛素口服在胃肠道内易被消化酶破坏，失去作用，而皮下注射则迅速被吸收。